在队列研究中，结局的确切概念是指
A. 统计检验结果
B. 暴露属性的分组结果
C. 观察中出现了预期结果事件
D. 观察期限的终止时间
E. 研究队列中存在的混杂结果

正确答案：C。观察中出现了预期结果事件

解析：本题考查结局。结局是指随访观察中将出现的预期结果事件（C对ABDE错），是队列研究观察的自然终点。